依据中药药性理论，寒凉性对人体的不良作用是
A. 伤阳
B. 耗气
C. 伤阴
D. 敛邪
E. 肺火

正确答案：A。伤阳

解析：本题考查的是药物四气的所示效用。依据中药药性理论，寒凉性对人体的不良作用是伤阳（A对）。四气，从本质而言只有寒热二性。凡寒凉性药物，即表示其具有清热、泻火、凉血、解热毒等作用；凡温热性药物，即表示其具有温里散寒、补火助阳、温经通络、回阳救逆等作用。四气对人体的作用也有两面性，倘若应用不当，即可对人体产生不良作用。此时，寒凉性有伤阳助寒之弊，而温热性则有伤阴（C错）助火之害。耗气（B错）伤阴是辛味药的不良作用。辛味药大多能耗气伤阴，气虚阴亏者慎用。敛邪（D错）是酸味药、涩味药的不良作用。酸味药、涩味药大多能收敛邪气，凡邪实未尽之证均当慎用。